女，30岁，开口受限1年，既往有关节弹响史。临床检查见开口度1指半，开口型左偏。首先应进行许勒位及升支侧位检查。下列表现中，哪一项不是颞下颌关节紊乱综合征的表现
A. 关节间隙改变
B. 髁突运动度改变
C. 两侧关节形态不对称
D. 髁状突骨质硬化
E. 关节结构为T形致密团块代替

正确答案：E。关节结构为T形致密团块代替

解析：本题考查颞下颌关节紊乱综合征的影像学表现。关节结构为T形致密团块代替的疾病为颞下颌关节强直（E错，为本题的正确答案）。颞下颌关节紊乱征是颞下颌关节最常见的疾病，影像学表现为：1.关节间隙改变（A对）；2.髁突运动度改变（B对）；3.两侧关节形态不对称（C对）；4.骨质改变：主要的骨质改变如下：髁突硬化（D对）、髁突前斜面模糊不清等。